根据《药品经营质量管理规范实施细则》，药品零售企业的营业店堂应做到
A. 陈列药品的类别标签应放置准确、字迹清晰
B. 明示服务公约、公布监督电话、设置顾客意见簿
C. 陈列药品的货柜及橱窗应保持清洁和卫生
D. 对顾客反映的问题，请坐堂医生解决
E. 对陈列药品应按月进行检查

正确答案：A、B、C、E。陈列药品的类别标签应放置准确、字迹清晰；明示服务公约、公布监督电话、设置顾客意见簿；陈列药品的货柜及橱窗应保持清洁和卫生；对陈列药品应按月进行检查

解析：本题考查的是药品零售企业的经营管理。根据《药品经营质量管理规范实施细则》，药品零售企业的营业店堂应做到陈列药品的类别标签应放置准确、字迹清晰（A对）、明示服务公约、公布监督电话、设置顾客意见簿（B对）、陈列药品的货柜及橱窗应保持清洁和卫生（C对）、对陈列药品应按月进行检查（E对）。《药品经营质量管理规范实施细则》第七十一条规定，药品零售企业和零售连锁门店在营业店堂陈列药品时，除按《规范》第七十七条的要求外，还应做到：（一）陈列药品的货柜及橱窗应保持清洁和卫生，防止人为污染药品。（二）陈列药品应按品种、规格、剂型或用途分类整齐摆放，类别标签应放置准确、字迹清晰。（三）对陈列的药品应按月进行检查，发现质量问题要及时处理。第七十六条规定，药品零售企业和零售连锁门店应在营业店堂明示服务公约，公布监督电话和设置顾客意见簿。对顾客反映的药品质量问题，应认真对待、详细记录、及时处理。